关于大卫生观的基本思想正确的是
A. 着眼于大卫生系统的动态性与开放性和科学协调管理
B. 强调政府主导和全权管理
C. 以“健康为人人，人人为健康”和实现高级卫生保建、重点在城市为主要内容
D. 实现初级卫生保健，先城镇，后农村，逐步实现
E. 实现人人享有绝对健康的目标

正确答案：A。着眼于大卫生系统的动态性与开放性和科学协调管理